下列实验室检查结果中，支持再生障碍性贫血的是
A. 网织红细胞增高
B. 外周血淋巴细胞比例减低
C. 中性粒细胞碱性磷酸酶积分减低
D. 骨髓中巨核细胞减低
E. 骨髓中非造血细胞减低

正确答案：D。骨髓中巨核细胞减低